血尿的常见原因不包括
A. 输尿管结石
B. 急性膀胱炎
C. IgA肾病
D. 单纯性肾囊肿
E. 膀胱癌

正确答案：D。单纯性肾囊肿

解析：血尿的常见原因包括：泌尿系结石（如肾、输尿管结石）（A对）、泌尿系感染（如急性膀胱炎）（B对）、泌尿系肿瘤（如膀胱癌）（E对）、泌尿系结核（如肾结核）、泌尿系外伤（如肾损伤、输尿管损伤）、肾小球疾病（如肾小球肾炎、IgA肾病）（C对）等。单纯性肾囊肿（D错，为本题正确答案）一般没有症状，只有当囊肿压迫引起血管闭塞或尿路梗阻时才可出现相应表现。